使用螺内酯的心力衰竭患者，不宜选用的药品是
A. 果糖
B. 氯化钾
C. 氯化钙
D. 硫酸镁
E. 葡萄糖

正确答案：B。氯化钾

解析：本题考查药物相互作用。使用螺内酯的心力衰竭患者，不宜选用的药品是氯化钾（B对）。螺内酯与其他保钾利尿药、含钾药物、血管紧张素转化酶抑制剂以及环孢素合用时，可增加高钾血症的机会。果糖（A错）不能与碱性药物及钙剂合用。氯化钙（C错）不宜与与强心苷合用。硫酸镁（D错）不能与阿片类镇痛药合用。葡萄糖（E错）会诱发洋地黄类强心苷中毒，其主要是因为葡萄糖合成糖原时会消耗钾，因此两者合用时要注意及时补钾。